判断肝癌的疗效及预后
A. 内镜检查
B. 脱落细胞检查
C. 超声波断层检查
D. 甲胎蛋白定量测定
E. 选择性动脉造影

正确答案：D。甲胎蛋白定量测定

解析：正常情况下，甲胎蛋白蛋白主要来自胚胎的肝细胞。但当肝细胞发生癌变时，即恢复了甲胎蛋白的功能。甲胎蛋白是诊断原发性肝癌的特异性肿瘤标志物，具有确立诊断、判断治疗效果和预后的作用（D对）。内镜检查通过人体自然腔道对人体进行检查，不适应于肝脏，主要用于早期食管癌胃癌诊断（A错）。脱落细胞检查主要适用于乳腺癌、鼻咽癌、消化道癌（B错）。超声波断层检查主要用于判断乳腺癌，也可用于诊断肝癌，但是不能够提示肝癌预后（C错）。选择性动脉造影主要用于诊断冠心病和心肌梗死（E错）。